某学生参加小学入学体检，远视力左眼0.5，右眼1.0。到眼科医院就诊，医生对他进行屈光矫正后，远视力为0.7。按照性质，所患眼病属于
A. 斜视性
B. 屈光参差性
C. 形觉剥夺性
D. 屈光不正性
E. 轴性

正确答案：B。屈光参差性